患者到药店购买“扑尔敏片”药师应给予
A. 氯苯那敏片
B. 阿昔洛韦片
C. 更昔洛韦片
D. 奥司他韦片
E. 苯海拉明片

正确答案：A。氯苯那敏片

解析：本题考查药物的别名。患者到药店购买“扑尔敏片”药师应给予氯苯那敏片（A对）。马来酸氯苯那敏别名为扑尔敏。阿昔洛韦（B错）的别名为无环鸟苷片或克毒星。更昔洛韦片（C错）的别名为赛美维。奥司他韦片（D错）的别名为达菲。苯海拉明片（E错）的别名为苯那君。